可使用非水溶液滴定法测定含量的药物有
A. 盐酸利多卡因
B. 盐酸氯丙嗪
C. 维生素B₁
D. 黄体酮
E. 维生素A

正确答案：A、B、C。盐酸利多卡因；盐酸氯丙嗪；维生素B₁